关于面神经核的说法何者正确
A. 位于面神经丘的深面
B. 司面部感觉
C. 只接受对侧皮质核束支配
D. 支配面部咀嚼肌运动
E. 以上都不对

正确答案：E。以上都不对

解析：面神经核位于展神经核的腹外侧，而展神经核位于面神经丘的深面，因而面神经核不位于面神经丘的深面（A错）。面神经核支配面肌活动，其上部接受双侧皮质核束支配（C错），支配同侧眼裂以上的表情肌；下部仅接受对侧皮质核束支配，支配同侧眼裂以下的表情肌。司面部感觉（B错）的脑神经核为三叉神经脑桥核、三叉神经脊束核。支配面部咀嚼肌运动（D错）的脑神经核为三叉神经运动核。因而E为本题正确答案。